病理改变在肾脏，临床表现为膀胱刺激症状，最常发生此种情况的泌尿系疾病是
A. 肾肿瘤
B. 鹿角型肾结石
C. 肾损伤
D. 泌尿系结核
E. 肾积水

正确答案：D。泌尿系结核

解析：肾结核早期病变主要是肾皮质内多发性结核结节，随病变进展，病变侵入肾髓质后不能自愈，进行性发展，结核分枝杆菌及脓细胞随尿流进入膀胱，表现出尿频、尿急、尿痛即膀胱刺激症状，故病理改变在肾脏，临床表现为膀胱刺激症状的是泌尿系结核（D对）。肾肿瘤（A错）主要表现为全程无痛性肉眼血尿、腰痛及腹部肿块，一般无膀胱刺激症状。鹿角型肾结石（B错）主要表现肾区疼痛伴肋脊角叩击痛、血尿等，伴感染时可出现膀胱刺激征。肾损伤（C错）主要表现为伤后疼痛、血尿，严重者可出现休克症状，不会出现膀胱刺激症状。肾积水（E错）主要由于泌尿系梗阻所致，表现为腰腹部无痛性包块，伴恶心、呕吐、尿少，不出现膀胱刺激征。